下列各项，不属于岩的病因病机的是
A. 情志郁结
B. 六淫之邪
C. 脏腑失调
D. 饮食不节
E. 感受特殊之毒

正确答案：E。感受特殊之毒

解析：特殊之毒包括虫毒、蛇毒、疯犬毒、药毒、食物毒，以及疫毒，不为岩的病因（E对）。岩是发生于体表的恶性肿物的统称，其病因病机有：情志郁结，导致气机失畅，气滞日久，必致血瘀，气滞血瘀长期蕴结，可逐渐形成岩（A错）。六淫之邪，乘虚内侵，导致气血凝结，阻滞经络，影响内脏的正常功能，邪浊与郁气、积血相合为病，留积不散，久之结为岩（B错）。脏腑失调，而致正气虚弱，邪气留滞而致气滞血瘀，痰凝毒聚，互相搏结而致岩（C错）。饮食不节，恣食辛辣厚味，脾胃受损，不能运化水湿，久积成湿毒；或兼受邪火熬灼成痰，痰浊积聚而为岩（D错）。